关于Ⅱ度营养不良的诊断标准，下列哪项是错误的
A. 体重低于正常均值25%～40%
B. 身长低于正常
C. 皮肤稍苍白松弛
D. 消瘦明显
E. 肌张力基本正常

正确答案：E。肌张力基本正常

解析：本题考查Ⅱ度营养不良的诊断标准。Ⅱ度营养不良：体重低于正常均值25%～40%（A对），身高低于正常（B对），腹壁皮下脂肪厚度小于0.4厘米，消瘦明显（D对）。精神不振，烦躁不安，肌张力减弱（E错，为本题正确答案），皮肤苍白松弛（C对）、干燥，毛发无光泽。